59.男性，21岁。骑自行车摔伤右腰部，伤后腰部疼痛，无肉眼血尿。查体：血压，脉搏正常。右腰部无包块，但叩击痛明显。尿常规：显微镜下红细胞充满视野。诊断哪种损伤确切
A. 重度肾损伤
B. 肾挫伤
C. 中度肾损伤
D. 血管损伤
E. 输尿管损伤

正确答案：B。肾挫伤

解析：青年男性患者，右腰部撞伤（提示可能有右肾损伤）后腰部痛，右腰部无包块，但叩击痛，尿常规示红细胞充满/HP（正常值为0～3个/HP，提示肾损伤），血压，脉搏正常（提示患者病情较轻），结合患者病史、临床表现和相关检查，诊断为肾挫伤（B对）确切。中度肾损伤（C错）和重度肾损伤（A错）会有明显血尿、腰腹部可触及肿块，甚至因大出血而出现休克。单纯肾血管损伤（主要指肾脏大血管）（D错）较少见，一旦出现可引起大出血。输尿管损伤（E错）较少见，多为医源性损伤，可表现为血尿、尿外渗和尿瘘，易被其他脏器损伤的表现所掩盖。